下列属于非处方药的药物有
A. 西咪替丁
B. 雷尼替丁
C. 法莫替丁
D. 兰索拉唑
E. 西沙必利

正确答案：A、B、C、D。西咪替丁；雷尼替丁；法莫替丁；兰索拉唑